确诊肺栓塞的辅助检查首选
A. 血D-二聚体
B. 超声心动图
C. CT肺动脉造影
D. 血气分析
E. 肺功能检查

正确答案：C。CT肺动脉造影

解析：肺血栓栓塞症是来自静脉系统或右心的血栓阻肺动脉或其分支所导致的以肺循环和呼吸功能障碍为主要临床和病理生理特征的疾病。CT肺动脉造影为确诊肺栓塞的辅助检查首选（C对）；血D-二聚体检查，对PTE有重要的排除诊断价值，但特异性差，对PTE无诊断价值（A错）；超声心动图，对提示PTE和除外其他心血管疾病以及进行急性PTE危险度分层有重要价值，但不作为确诊检查（B错）；血气分析，常表现为低氧血症、低碳酸血症，肺泡－动脉血氧分压差增大，部分病人的血气结果可以正常，不作为PTE的确诊检查（D错）；肺功能检查一般不作为PTE的检查项目（E错）。